在吸烟与肺癌关系的病例对照研究中，已知性别与吸烟有关，不同性别发生肺癌的频率不同，在研究中对照组中女性占80％，男性占20％，而病例组女性占20％，男性占80％，这可能会造成
A. 选择偏倚
B. 信息偏倚
C. 混杂偏倚
D. 错分偏倚
E. 观察偏倚

正确答案：C。混杂偏倚